关于脊髓的说法,何者错误
A. 其中与颈膨大相连的神经分布到颈部
B. 呈扁圆柱形
C. 成年人下端约平第一腰椎体下缘
D. 上端在枕骨大孔处与脑相续
E. 灰质在中央部,其中与腰膨大相连的神经主要分布到下肢

正确答案：A。其中与颈膨大相连的神经分布到颈部

解析：脊髓呈前、后稍扁的圆柱形（B对），有两个梭形膨大部：颈膨大和腰骶膨大，两个膨大的形成是由于此处神经细胞和纤维数目增多所致，与四肢的出现有关，即与颈膨大相连的神经分布到上肢（A错，为本题正确选项），与腰骶膨大的神经分布到下肢（E对）。脊髓上端在枕骨大孔处与延髓相连，下端变细呈圆锥状称脊髓圆锥（D对），尖端约平对第1腰椎下缘（C对）。